在突触传递过程中，触发神经末梢递质释放的关键因素是
A. 末梢内囊泡数量增加
B. Ca²⁺进入末梢内
C. 末梢膜发生超极化
D. 末梢膜上K⁺通道激活
E. 末梢内线粒体数量增加

正确答案：B。Ca²⁺进入末梢内

解析：在突触传递过程中，突触前神经元的兴奋传到末梢时，突触前膜发生去极化（C错），去极化达到一定水平时，通过激活突触前膜中的电压门控钙通道（D错），导致Ca²⁺内流进入神经末梢内而触发囊泡的出胞（B对），引起轴突末梢释放神经递质。末梢内囊泡数量增加（A错）、末梢内线粒体数量增加（E错）非引起递质释放的关键因素。